下列哪种牙列缺损，需间接固位体
A. 前牙缺失
B. 多数后牙缺失
C. 末端游离缺失
D. 间隙缺失
E. 多数前牙缺失

正确答案：C。末端游离缺失

解析：本题考查间接固位体的适用。末端游离缺失（C对）需间接固位体增加义齿的稳定性。多数前牙缺失（A错）时，可通过大基板或前基板、后腭杆连接起来。